强心苷最严重的毒性反应是
A. 失眠
B. 心室颤动
C. 黄视症
D. 惊厥
E. 腹泻

正确答案：B。心室颤动

解析：强心苷是一类选择性作用于心脏，具有加强心肌收缩力作用的苷类化合物，临床用于慢性心功能不全、心律失常，安全范围小，有效血药浓度接近中毒血药浓度的60%，且患者对强心苷的敏感性及耐受性有较大的个体差异，容易发生中毒发应，其中心脏毒性为强心苷最严重的中毒反应，可引起多种中毒反应，如快速性心律失常甚至发展为室颤，其中室性早搏及联律最常见且最早出现，属于中毒先兆，为停药指征，室性心动过速最为严重，应立即停药并抢救，以免发展成为致死性的室颤（B对）。强心苷为中枢神经系统反应包括眩晕、头痛、疲倦、失眠（A错）、谵妄及视力模糊、黄视症（C错）和绿视症等症状，其中视色障碍是强心苷中毒时的特有症状，可作为停药的指征。胃肠道反应为强心苷中毒的最常见的早期变现，可出现厌食、恶心、呕吐、腹泻（E错）等，强心苷无惊厥的不良反应（D错）。